某患者排出的尿液呈云雾状，静置后不下沉，加热及加酸沉淀不消失，应考虑为
A. 乳糜尿
B. 菌尿
C. 尿酸盐沉积
D. 磷酸盐沉积
E. 正常尿液

正确答案：B。菌尿

解析：菌尿呈云雾状，静置后不下沉，不论加热、加酸，其混浊均不消失（B对）。乳糜尿：呈乳白色，因肾周围淋巴通道阻塞，从肠道吸收的淋巴液逆流进入尿中所致（A错）。正常新鲜尿液清澈透明，一般为黄色或淡黄色（E错）。如新鲜尿液混浊即呈粉红色颗粒状，加热或加碱使混浊消失，即为尿酸盐（C错）；呈灰白色，加热后混浊增加，再加入醋酸，混浊变清，即为磷酸盐或碳酸盐（D错）。